麻疹的常见潜伏期为
A. 3～5天
B. 6～8天
C. 9～11天
D. 18～25天
E. 2～3天

正确答案：C。9～11天

解析：本题考查麻疹的潜伏期。麻疹的潜伏期大多在9～11天（C对ABDE错），主要借由飞沫通过呼吸道和眼结膜传播。